X线表现可见大片致密的骨质硬化改变，骨膜增生明显，软组织肿块中有肿瘤骨形成应考虑的疾病是
A. 溶骨型骨肉瘤
B. 成骨型骨肉瘤
C. 混合型骨肉瘤
D. 骨巨细胞瘤
E. 骨软骨瘤

正确答案：B。成骨型骨肉瘤

解析：X线表现可见大片致密的骨质硬化改变，骨膜增生明显，软组织肿块中有肿瘤骨形成见于成骨型肉瘤，这从间质细胞系发展而来，肿瘤迅速生长是由于肿瘤经软骨阶段直接或间接形成肿瘤骨样组织和骨组织（B对）。溶骨型：自骨髓腔和骨松质发展的溶骨性破坏，形成边缘模糊的密度减低区，其中不见骨组织或少见斑片状包壳骨影，骨皮质逐渐破坏（A错）。③混合型：多数病变兼有溶骨型和成骨型的骨质改变。可以成骨为主，或以溶骨为主（C错）。骨巨细胞瘤X线表现为病灶位于干骺端，呈偏心性、溶骨性、膨胀性骨破坏，边界清楚，有时呈皂泡样改变，多有明显包壳（D错）。骨软骨瘤X线表现为骨性病损自干骺端突出，因软骨帽和滑囊不显影，肿瘤的骨质影像与其所在部位干骺端的骨质结构完全相同，难区别（E错）。